队列研究在资料收集过程中易出现的偏倚是
A. 回忆偏倚
B. 混杂偏倚
C. 选择偏倚
D. 失访偏倚

正确答案：D。失访偏倚

解析：本题考查队列研究在资料收集过程中易出现的偏倚。队列研究在资料收集过程中易出现的偏倚是失访偏倚（D对ABCE错）。由于队列研究的随访时间长，失访往往是难以避免的。如果暴露组和对照组的失访人数相等，而且各组中失访者和未失访者的发病率相同，则可认为失访对研究结果没有大的影响；否则，暴露与结果之间的关系可能因失访而被歪曲，这种歪曲被称为失访偏倚。